缺乏细胞壁的原核细胞型微生物是
A. 衣原体
B. 病毒
C. 支原体
D. 螺旋体
E. 真菌

正确答案：C。支原体

解析：缺乏细胞壁的原核细胞型微生物是支原体（C对），它是最小的原核细胞型微生物。衣原体（A错）、螺旋体（D错）都是具有细胞壁结构的原核细胞型微生物。病毒（B错）是非细胞型微生物，没有细胞结构，只有一种核酸为遗传物质，必须在活细胞内才能显示出生命活性。真菌（E错）是真核细胞型微生物。